多形性红斑口腔病损临床表现正确的是
A. 最常见的病变为大面积糜烂，表面有大量的纤维素性渗出物形成厚的假膜
B. 唇部常形成较厚的黑色血痂
C. 疼痛明显，影响进食
D. 下颌下淋巴结肿大，有压痛
E. 以上均是

正确答案：E。以上均是

解析：本题考查多形性红斑口腔病损的临床表现。多形性红斑又称多形渗出性红斑，是黏膜皮肤的一种急性渗出性炎症性疾病。发病急，具有自限性和复发性。黏膜和皮肤可以同时发病，或单独发病。多形性红斑口腔病损临床表现最常见的病变为大面积糜烂，表面有大量的纤维素性渗出物形成厚的假膜（A对），有时渗出物过多，甚至形成胶冻状团块而影响张口。病损易出血，在唇部常形成较厚的黑紫色血痂（B对）。疼痛明显，影响进食（C对）。患者唾液增多，口臭明显，下颌下淋巴结肿大，有压痛（D对）。（ABCD均对，故E为本题的正确答案）。